手足口病是由以下哪种感染引起的
A. 人类疱疹病毒6型
B. 麻疹病毒
C. 风疹病毒
D. 多种肠道病毒
E. A组β溶血性链球菌

正确答案：D。多种肠道病毒